原穴主要治疗
A. 五脏六腑病证
B. 表里经脉病证
C. 五脏病证
D. 六腑病证
E. 急性病证

正确答案：A。五脏六腑病证

解析：本题考查各主要穴位的治疗病症。原穴主要治疗五脏六腑病症（A对）。络穴主要治疗表里经脉病症（B错）。背俞穴主要治疗五脏病症（C错）。募穴，下合穴主要治疗六腑病症（D错）。郄穴主要治疗急性病症（E错）。